X线钡餐检查显示“皮革胃”，多见于
A. 浅表性胃炎
B. 萎缩性胃炎
C. 肿块型胃癌
D. 溃疡型胃癌
E. 浸润型胃癌

正确答案：E。浸润型胃癌

解析：浅表性胃炎X线钡餐下可表现为胃黏膜纹理增粗、迂曲，可呈锯齿状，胃窦部出现激惹征（A错）。萎缩性胃炎则见黏膜失去正常颜色，呈淡红、灰色，呈弥散性，黏膜变薄，皱襞变细平坦，黏膜血管暴露，有上皮细胞增生或明显的肠化生（B错）。肿块型胃癌癌肿主要向腔内生长，呈结节状、息肉状（C错）。溃疡型胃癌又分为局限溃疡型和浸润溃疡型。前者的特征为癌肿局限，呈盘状，中央坏死。后者常有较大而深的溃疡，溃疡底一般不平，边缘隆起呈堤状或火山口状（D错）。弥漫浸润型胃癌若累及全胃，整个胃壁增厚、变硬，称为皮革胃（E对）。